8月的婴儿不可能出现的是
A. 指认身体部位
B. 扶墙站
C. 叫妈妈
D. 双手交换玩具
E. 自己坐

正确答案：A。指认身体部位

解析：8月的婴儿可以出现扶墙站（B对）、叫妈妈（C对）、双手交换玩具（D对）和自己坐（E对）的行为，指认身体部位（A错，为本题正确答案）在12月大的婴儿身上能够出现。